渗透性强，可透过甲板，属于吡啶酮类的抗真菌药物是
A. 特比萘芬
B. 克霉唑
C. 环吡酮胺
D. 米卡芬净
E. 制霉菌素

正确答案：C。环吡酮胺

解析：本题考查环吡酮胺。渗透性强，可透过甲板，属于吡啶酮类的抗真菌药物是环吡酮胺（C对）。环吡酮胺为吡啶酮类抗真菌药，用于浅部皮肤真菌感染，如体、股癖，手、足癣（尤其是角化增厚型），花斑癣，皮肤念珠菌病及甲癣。此药渗透性强，可渗透过甲板。特比萘芬（A错）是丙烯胺类抗真菌药。克霉唑（B错）为咪唑类抗真菌药。米卡芬净（D错）为棘白菌素类抗真菌药。制霉菌素（E错）为抗生素类抗真菌药。